合格的心理治疗家是
A. 受过系统训练
B. 患者的利益至上
C. 有建立和睦关系的能力
D. 要恰当估计自己的能力
E. 以上都正确

正确答案：E。以上都正确

解析：本题考查对合格的心理治疗家的要求。合格的心理治疗家是受过系统训练（A对），掌握了一定的专业理论和技能，有建立和睦关系的能力（C对），可以帮助患者治疗心理疾病，并且可以恰当估计自己的能力（D对），以患者的利益至上（B对）的专业人员。（ABCD均对，故E为本题的正确答案）。